女性，42岁，2个月来，情绪低落，兴趣索然，自觉“高兴不起来”，生不如死，“自己的脑子不灵了”，“像是生了锈的机器”，认为自己成了家庭和社会的累赘，“成了废物”，有胸闷、心悸、心慌的症状，自认为有严重心脏病，不能治愈。主动性言语及活动明显减少，生活被动，愿独处。曾多次自杀未遂，睡眠不好，早醒。该病人的精神症状不包括
A. 情绪低落
B. 思维迟缓
C. 自责自罪观念
D. 夸大妄想
E. 意志活动减退

正确答案：D。夸大妄想

解析：中年女性，2个月来，情绪低落，兴趣索然，自觉“高兴不起来”，生不如死，“自己的脑子不灵了”，“像是生了锈的机器”（典型的思维迟缓的症状），认为自己成了家庭和社会的累赘，“成了废物”（典型的自责自罪症状），有胸闷、心悸、心慌的症状，自认为有严重心脏病，不能治愈（典型疑病观念）。主动性言语及活动明显减少，生活被动，愿独处（典型的意志活动减低的症状）。曾多次自杀未遂（提示有自杀企图），睡眠不好，早醒。该病人的精神症状不包括夸大妄想（D对），该症状主要症状为认为自已拥有非凡的才能、智慧、财富、权利、地位等，该患者明显不存在该症状。